某HIV感染者，近日出现继发感染、衰竭、免疫缺陷等AIDS症状，入院治疗。目前认为最有效的治疗方案是
A. 蛋白酶抑制剂
B. 核苷类逆转录酶抑制剂
C. 鸡尾酒疗法（联合用药疗法）
D. 阿糖胞苷非核苷类逆转录酶抑制剂
E. 脱氧鸟苷单一用药疗法

正确答案：C。鸡尾酒疗法（联合用药疗法）

解析：HIV感染者应终生用药，以便降低其血液中病毒载量，推迟病情发展，延长生存期。使用抗病毒药物的原则是服用2种逆转录酶抑制剂（如AZT和3TC）与一种蛋白酶抑制剂（如IDV）联合用药（俗称鸡尾酒疗法），但应注意监测HIV耐药变异，以便及时变更用药方案。掌握“人类免疫缺陷病毒”知识点。